肌张力障碍的临床表现是一组肌群的
A. 伸肌和屈肌张力呈铅管样增强
B. 伸肌和屈肌张力呈断续停顿样增强
C. 低张力伴无目的急速多变的不自主动作
D. 促动和拮抗肌不协调收缩，出现不自主运动和异常姿势
E. 促动和拮抗肌协调收缩，出现不自主运动和异常姿势

正确答案：D。促动和拮抗肌不协调收缩，出现不自主运动和异常姿势

解析：肌张力障碍临床表现是一组肌群的促动和拮抗肌不协调收缩，出现不自主运动和异常姿势（D对E错），出现扭转痉挛、Meige综合征、痉挛性斜颈、手足徐动症等表现（P292-P293）。伸肌和屈肌张力呈铅管样增强（A错）、伸肌和屈肌张力呈断续停顿样增强（B错）分别见于帕金森病的铅管样强直和齿轮样强直（P279）。低张力伴无目的急速多变的不自主动作（C错）主要见于亨廷顿病的锥体外系症状（P291）。ABC是肌张力障碍的表现，但不是本题的最佳答案。